长期应用不但加速自身代谢，而且可加速其它和用药物代谢的肝药酶诱导剂的是
A. 苯巴比妥
B. 地西泮
C. 唑吡坦
D. 佐匹克隆
E. 阿普唑仑

正确答案：A。苯巴比妥

解析：本题考查苯巴比妥。苯巴比妥（A对）为巴比妥类中枢性镇静催眠药。巴比妥类药物为肝药酶诱导剂，可提高肝药酶活性，长期用药不但加速自身代谢，还可加速其它药物代谢。